主要用于治疗细菌外毒素所致疾病的
A. 治疗用抗原
B. 抗毒素血清
C. 治疗用细胞因子
D. 治疗用可溶性细胞因子受体
E. 治疗用非特异性免疫增强剂

正确答案：B。抗毒素血清

解析：治疗用抗体：抗毒素血清主要用于治疗细菌外毒素所致疾病，如破伤风和白喉。抗TNF-α单克隆抗体可治疗类风湿关节炎。抗CD20单克隆抗体可治疗非霍奇金淋巴瘤；抗VEGF单克隆抗体可治疗转移性结肠直肠癌；抗IgE单克隆抗体可治疗持续性哮喘。掌握“免疫预防及免疫治疗”知识点。